酮症糖尿病昏迷治疗的关键是
A. 降糖
B. 控制饮食
C. 纠正酸碱平衡
D. 补液
E. 消除诱因

正确答案：D。补液

解析：糖尿病酮症酸中毒（DKA）是因各种诱因使体内胰岛素缺乏，引起糖、脂肪、蛋白质代谢紊乱，出现以高血糖、高酮血症、代谢性酸中毒为主要表现的临床综合征。治疗当补液、应用胰岛素、纠酸、补钾、处理诱发病和防治并发症。补液可以维持血容量，降低血液中的渗透压和酸浓度，因此补液是关键（D对）。